在匹配病例对照研究中，病例与对照的比例最常用
A. 1:1
B. 1:2
C. 1:3
D. 1:4

正确答案：A。1:1

解析：本题考查病例对照研究的匹配比例。总样本量一定时，如果病例和对照的来源都较充足，病例与对照之比为1:1（A对BCD错）时的统计学效率最高。但如果所研究的是罕见病或所能获得的合格病例数很少，为了达到较满意的研究功效，可以增加匹配的对照数，即采用1：r匹配。